关于煎膏剂质量要求和注意事项的说法，正确的是
A. 煎膏剂质地黏稠，制备时不得加入药物细粉
B. 煎膏剂以滋补为主，兼有缓和的治疗作用
C. 出现“反砂”后的煎膏剂仍可使用
D. 除另有规定外，煎膏剂应密封，常温贮存
E. 除另有规定外，煎膏剂中加入炼蜜的量一般不超过清膏量的5倍

正确答案：B。煎膏剂以滋补为主，兼有缓和的治疗作用

解析：本题考查的是煎膏剂。关于煎膏剂质量要求和注意事项的说法，正确的是煎膏剂以滋补为主，兼有缓和的治疗作用（B对）。煎膏剂多以滋补为主，兼有缓和的治疗作用，是中医滋补、防衰老、治疗慢性病的传统剂型之一，但须在医生指导下使用。煎膏剂若需加入药粉，除另有规定外，一般应待冷却后加入细粉，搅拌均匀（A错）。煎膏剂含糖浓度高，制备时常常因为炼糖程度把握不好导致成品放置过程中析出糖的结晶，俗称“返砂”。“返砂”后的煎膏剂质量不稳定，不宜使用（C错）。除另有规定外，煎膏剂应密封，置阴凉处贮存（D错）。煎膏剂中加入炼蜜或炼糖（或转化糖）的量，一般不超过清膏量的3倍（E错）。